胎头矢状缝与骨盆入口右斜径一致的胎位是
A. 枕左后
B. 枕左前
C. 枕左横
D. 枕右前
E. 枕右横

正确答案：B。枕左前

解析：右斜径即右骶髂关节至左髂耻隆突间的距离。分娩时胎头取半俯屈状态以枕额径进入骨盆入口，由于枕额径大于骨盆入口前后径，胎头矢状缝坐落在骨盆入口右斜径上，即胎头矢状缝与骨盆入口右斜径一致，此时胎头枕骨位于母体骨盆的左前方，即胎位是枕左前（B对）。